女，36岁。体检发现心动过缓就诊，无不适。查体：BP90/60mmHg，心率56次/分，心律齐。心电图示窦性心律。患者心动过缓最可能的机制是
A. 窦房结细胞T型钙通道激活减少
B. 窦房结细胞内向离子流明显增强
C. 房室延搁时间延长
D. 房室交界区的前传不应期延长
E. 窦房结细胞钾外流衰减明显加快

正确答案：A。窦房结细胞T型钙通道激活减少

解析：BP90/60mmHg，心率56次/分，心律齐，心电图示窦性心律，诊断为窦性心动过缓。影响窦房结自律性的因素包括自律细胞动作电位4期自动去极化的速度、最大复极电位和阈电位水平，其中以4期自动去极化速度最为重要。窦房结4期自动去极化离子机制为外向电流减弱和内向电流增强两个方面，其中最重要的是IK、If和ICa-T。患者心动过缓最可能的机制是窦房结细胞T型钙通道激活减少（A对）。窦房结细胞内向离子流明显增强（B错）和窦房结细胞钾外流衰减明显加快（E错）可以加快自动去极化速率，会使心率加快。房室延搁时间延长（C错）和房室交界区的前传不应期延长（D错）主要是影响心肌的传导性，使传导减慢。